不稳定型心绞痛患者应争取在2小时内进行介入评估的临床情况是
A. 发作时间较前延长
B. 发作时出现左心衰
C. ST段水平型下移
D. 静息心绞痛发作
E. ST段下斜型下移

正确答案：B。发作时出现左心衰

解析：不稳定型心绞痛患者应争取在2小时内进行介入评估的临床情况是发作时出现左心衰（B对）、存在顽固性心绞痛、伴有威胁生命的室性心律失常以及血流动力学不稳定。发作时间较前延长（A错）是恶化型心绞痛的特点（八年制内科学P306）。大多数患者胸痛发作时有一过性ST段（抬高和压低）（CE错）和T波（低平或倒置）改变。静息心绞痛发作（D错）在休息时发作，持续时间较长，非急诊PCI指征。